心肌不产生完全强直收缩的原因是心肌
A. 为功能合胞体
B. 有自律性
C. 肌质网不发达
D. 呈全或无收缩
E. 有效不应期特别长

正确答案：E。有效不应期特别长